患者徐某，男，35岁。自述咯痰不爽，涩而难出，咽喉干燥，舌苔白而干，脉细治宜选用
A. 温胆汤
B. 清气化痰丸
C. 止嗽散
D. 贝母瓜蒌散
E. 二陈汤

正确答案：D。贝母瓜蒌散

解析：“咯痰不爽，涩而难出，咽喉干燥，舌苔白而干，脉细”提示内有燥痰，当治以润肺清热，理气化痰，方选贝母瓜蒌散（D对）--方中以贝母为君，取其润肺清热，化痰止咳。臣以瓜蒌，润肺清热，理气化痰。佐以天花粉润燥生津，清热化痰；橘红理气化痰，使气顺痰消；茯苓健脾渗湿，以杜生痰之源；桔梗宣利肺气，令肺金宣降有权。温胆汤功用为理气化痰，清胆和胃，主治胆胃不和，痰热内扰证（A错）。清气化痰丸功用为清热化痰，理气止咳，主治热痰咳嗽（B错）。止嗽散功用为宣利肺气，疏风止咳，主治风邪犯肺证（C错）。二陈汤功用为燥湿化痰，理气和中，主治湿痰证（E错）。